经颅侧斜位片上，关节间隙为位于关节窝与髁突之间的低密度影像，关节间隙主要被什么所占据
A. 颞下颌关节
B. 关节结节
C. 颞骨
D. 关节盘
E. 髁突横嵴

正确答案：D。关节盘

解析：本题考查经颅侧斜位片。经颅侧斜位片上，关节间隙为位于关节窝与髁突之间的低密度影像，关节间隙主要被关节盘（D对）所占据。经颅侧斜位片上，关节间隙为位于关节窝与髁突之间的低密度影像，主要为关节盘所占据。关节间隙2mm以上，上间隙最宽，后间隙次之，前间隙最窄，两侧对称。